有关粉碎的不正确表述是
A. 粉碎是将大块物料破碎成较小颗粒或粉末的操作过程
B. 粉碎的主要目的是减小粒径，增加比表面积
C. 粉碎的意义在于有利于固体药物的溶解和吸收
D. 粉碎的意义在于有利于减少固体药物的密度
E. 粉碎的意义在于有利于提高固体药物在液体、半固体中的分散性

正确答案：D。粉碎的意义在于有利于减少固体药物的密度